为了保证研究结果能够回答研究目的中提出的问题，使用的人财物时间较少，结果可靠，应该作好的首要工作是
A. 资料搜集
B. 科研设计
C. 资料整理
D. 资料分析
E. 结果的表达

正确答案：B。科研设计

解析：进行一项科学研究主要包括科研设计、资料搜集、资料整理、资料分析及结果的表达几个步骤，其中科研设计是医学科研工作的第一步，是保证以较少的人力、物力和财力，使研究结果能够回答研究目的中提出的问题，获取准确、可靠的科学结论的一个重要手段（B对）。